临床应用局麻时常在麻药溶液中加入血管收缩剂，常用的药物是
A. 肾上腺素
B. 去甲肾上腺素
C. 异丙肾上腺素
D. 阿托品
E. 多巴胺

正确答案：A。肾上腺素

解析：常用肾上腺素以1:50000～1:200000的浓度加入局麻药溶液中，用作局部浸润麻醉和阻滞麻醉，也有选用血管收缩剂盐酸苯肾上腺素（新福林）等药物。掌握“颌面部常用局部麻醉药物”知识点。